工业粉尘属于
A. 生物性危险因素
B. 物理性危险因素
C. 化学性危险因素
D. 环境危险因素
E. 社会环境危险因素

正确答案：C。化学性危险因素